6-巯基嘌呤、5-氟尿嘧啶具有抗肿瘤作用的可能机制是
A. 抑制嘌呤的补救合成
B. 抑制RNA聚合酶
C. 抑制DNA聚合酶
D. 碱基错配
E. 抑制蛋白质合成

正确答案：A。抑制嘌呤的补救合成

解析：某些药物是嘌呤、嘧啶、叶酸以及某些氨基酸的类似物，它们可作为核苷酸的抗代谢物，通过竞争性抑制等方式干扰或阻断核苷酸的正常合成代谢，由此阻断核酸合成中的原料供给，因而可抑制细胞增殖，临床上常用作抗肿瘤药物。主要的核苷酸抗代谢物有6-巯基嘌呤（6-MP）、5-氟尿嘧啶（5-FU）、氨基蝶呤和甲氨蝶呤（MTX）和氮杂丝氨酸等。掌握“核苷酸代谢及调节”知识点。